女，54岁。腹痛、腹胀、乏力3个月。腹部隐痛阵发性发作。查体：贫血貌，浅表淋巴结无肿大，巩膜无黄染，腹软，未见肠型，右下腹可触及一活动性包块。实验室检査：Hb90g/L，WBC9.5×10⁹/L，肝功能正常，CEA20ug/L。粪隐血试验阳性。最可能的诊断是
A. 回盲部套叠
B. 回盲部结核
C. 溃疡性结肠炎
D. 回盲部肿瘤
E. 克罗恩病

正确答案：D。回盲部肿瘤

解析：中年女性患者，腹痛、腹胀、乏力3个月，贫血貌，腹软，未见肠型，右下腹可触及一活动性包块（提示腹腔内占位性病变），CEA20ug/L（正常CEA＜5ug/L，提示恶性肿瘤），粪隐血试验阳性（提示消化道出血），结合患者病史和相关检查，最可能的诊断为回盲部肿瘤（D对）。回盲部套叠（A错）是肠套叠的一种类型，多见于2岁以下的儿童，常表现为突然发作剧烈的阵发性腹痛、血便和腹部肿块，肿块常位于脐右上方，右下腹扪诊有空虚感。回盲部结核（B错）常继发于肺结核，主要表现为腹痛、腹泻及低热、盗汗等结核中毒症状，腹痛多位于右下腹或脐周，一般无贫血及大便隐血试验阳性等。溃疡性结肠炎（八版内科学P385-P386）（C错）主要表现为反复发作的腹泻、黏液脓血便和腹痛，常有里急后重，便后腹痛缓解。克罗恩病（E错）多发生于15～30岁的青年人，主要表现为反复发作的右下腹或脐周痛、腹泻、体重下降，伴肠梗阻、腹部压痛、腹块、肠瘘、发热等。